对铜绿假单胞菌作用最弱的氨基苷类抗生素是
A. 卡那霉素
B. 庆大霉素
C. 阿米卡星
D. 妥布霉素
E. 链霉素

正确答案：E。链霉素

解析：本题考查氨基苷类抗生素。对铜绿假单胞菌作用最弱的氨基苷类抗生素是链霉素（E对）。卡那霉素（A错）对多数常见G⁻菌和结核杆菌有效，目前与其他抗结核病药物合用，治疗对第一线药物产生耐药性的结核患者，也可口服用于肝昏迷或腹部术前准备的患者。庆大霉素（B错）是治疗各种G⁻杆菌感染的主要抗菌药，尤其对沙雷菌属作用更强，为氨基糖苷类中的首选药，可与青霉素或其他抗生素合用，协同治疗严重的肺炎球菌、铜绿假单胞菌、肠球菌、葡萄球菌或草绿色链球菌感染，亦可用于术前预防和术后感染，还可局部用于皮肤、黏膜表面感染和眼、耳、鼻部感染。阿米卡星（C错）是抗菌谱较广的氨基糖苷类抗生素，对G⁻杆菌和金黄色葡萄球菌均有较强的抗菌活性，但作用较庆大霉素弱，其突出优点是对肠道G⁻杆菌和铜绿假单胞菌所产生的多种氨基糖苷类灭活酶稳定，故对一些氨甚糖苷类耐药菌感染仍能有效控制，常作为首选药。妥布霉素（D错）对铜绿假单胞菌的作用是庆大霉素的2〜5倍，且对耐庆大霉素菌株仍有效，适合治疗铜绿假单胞菌所致的各种感染，通常应与能抗铜绿假单胞菌的青霉素类或头孢菌素类药物合用。